退货药品库（区）应标示
A. 红色色标
B. 黄色色标
C. 蓝色色标
D. 绿色色标
E. 紫色色标

正确答案：B。黄色色标

解析：本题考查药品储存的色标管理。退货药品库为黄色（B对）。